阴虚的常见症状是
A. 脉沉
B. 神疲
C. 乏力，眩晕
D. 五心烦热
E. 舌红，苔黄腻

正确答案：D。五心烦热

解析：本题考查的是阴虚证的临床表现。阴虚的常见症状是五心烦热（D对）。阴虚与阳虚：阴虚与阳虚，是指机体阴阳亏损而导致的阴不制阳、阳不制阴的阴虚证和阳虚证候。阴虚证的临床表现，除见形体消瘦、口燥咽干、眩晕（C错）失眠、舌红脉细数等阴液不足的症状外，还常伴见五心烦热、潮热盗汗、舌红绛、脉数等阴不制阳、虚热内生的症状。阳虚证的临床表现，除见神疲（B错）乏力、少气懒言、蜷卧嗜睡、脉微无力等气虚功能衰减的症状外，还常兼见畏寒肢冷、口淡不渴、尿清便溏或尿少肿胀、面白舌淡等阳不制阴、水寒内盛的症状。脉沉（A错）为脾阳虚的临床表现。脾阳虚证的临床表现，常见在脾失健运症状的基础上，同时出现腹中冷痛，腹满时减，得温则舒，口泛清水，四肢不温，气怯形寒，脉沉迟而舌淡苔白。妇女则见白带清稀，小腹下坠，腰酸沉等症。舌红，苔黄腻（E错）为肝胆湿热证的临床表现。肝胆湿热证临床表现，常见胁肋满闷疼痛，黄疸，小便短赤，或小便黄而浑浊，或带下色黄腥臭，外阴瘙痒，或睾丸肿痛，红肿灼热，舌苔黄腻，脉弦数。一般以胁肋胀痛、身目发黄或阴部瘙痒、带下黄臭、舌红苔黄腻为辨证要点。